心力衰竭最具特征的血流动力学变化是
A. 肺循环淤血
B. 心输出量不足
C. 体循环淤血
D. 静脉回流障碍
E. 毛细血管通透性增加

正确答案：B。心输出量不足

解析：各种病因使心脏收缩和（或）舒张功能受损，心输出量不足，引起器官组织灌流量减少和肺循环、体循环淤血，导致心力衰竭。因而心力衰竭最具特征的血流动力学变化是心输出量不足（B对）。